女性的肺癌大多是
A. 腺癌
B. 鳞状细胞癌
C. 印戒细胞癌
D. 粘液腺癌
E. 小细胞未分化癌

正确答案：A。腺癌

解析：女性的肺癌大多是肺腺癌（A对），约占50%以上。肺鳞状细胞癌（B错）多见于中老年人和有吸烟史的患者。小细胞未分化癌（P183）（E错）多见于有吸烟史的老年男性患者。粘液腺癌（P97）（D错）和印戒细胞癌（C错）多见于胃和大肠，极少发于肺脏。